慢性支气管炎早期最可能发生的肺功能改变是
A. 第一秒用力呼气量降低
B. 总肺活量升高
C. 用力呼气量减低
D. 小气道功能异常
E. 残气量异常

正确答案：D。小气道功能异常

解析：慢性支气管炎早期一般没有明显的病理生理改变，少数患者可检出小气道的功能异常，随着病情加重逐渐出现气道狭窄、阻力增加和气流受限。故慢性支气管炎肺功能的早期改变是小气道功能异常（D对），表现为最大呼气流速-容量曲线在75%和50%容量时明显降低，闭合气量和闭合容量明显增高。而第一秒用力呼气量降低（A错）、用力呼气量减低（C错）以及残气量异常（E错）均可出现于慢性阻塞性肺疾病中，不会出现在慢性支气管炎的早期。总肺活量升高（B错）提示身体耐力好，在经常运动的人中可出现。